根据《药品经营质量管理》关于药品零售企业各类人员配备和资格要求的说法，正确的是
A. 中药饮片调剂人员应是中药学中专以上学历或者具备中药调剂员资格
B. 质量管理部门负责人应具备有大学本科以上学历和3年以上药品调剂员资格
C. 中药采购人员应是中药中专以上学历或者具有中药学专业初级以上专业技术职称
D. 企业法人代表或企业负责人应具备执业药师资格

正确答案：A、C、D。中药饮片调剂人员应是中药学中专以上学历或者具备中药调剂员资格；中药采购人员应是中药中专以上学历或者具有中药学专业初级以上专业技术职称；企业法人代表或企业负责人应具备执业药师资格

解析：本题考查药品零售企业经营和质量管理人员的资质要求。根据《药品经营质量管理》关于药品零售企业各类人员配备和资格要求的说法，正确的是中药饮片调剂人员应是中药学中专以上学历或者具备中药调剂员资格（A对）；中药采购人员应是中药中专以上学历或者具有中药学专业初级以上专业技术职称（C对）；企业法人代表或企业负责人应具备执业药师资格（D对）。药品零售企业经营和质量管理人员的资质要求：法定代表人或者企业负责人应当具备执业药师资格。企业应当按照国家有关规定配备执业药师，负责处方审核，指导合理用药。从事中药饮片质量管理、验收、采购人员应当具有中药学中专以上学历或者具有中药学专业初级以上专业技术职称（B错）。中药饮片调剂人员应当具有中药学中专以上学历或者具备中药调剂员资格。